膀胱炎最易发生于
A. 女性婴幼儿
B. 50岁以上男性
C. 育龄妇女
D. 老年妇女
E. 青年男性

正确答案：C。育龄妇女

解析：膀胱炎为下尿路感染。女性尿道特点为宽、短、直，此解剖特点可以使细菌更容易通过尿道进入下尿路甚至上尿路；育龄女性的经血是细菌最好的培养基，经期不注意卫生也会导致感染机会增加；性生活也是重要因素，因其可以使得细菌逆行感染膀胱或后尿道，故膀胱炎最易发生于育龄妇女（C对）。